下丘脑分泌
A. GnRH
B. 促性腺激素
C. 性激素，包括雌激素、孕激素和少量雄激素
D. 绒毛膜促性腺激素
E. 糖皮质激素、盐皮质激素

正确答案：A。GnRH

解析：本题考查下丘脑分泌分泌的激素。随着中枢神经系统下丘脑逐渐发育，对性甾体激素负反馈作用敏感性降低，促使下丘脑分泌的促性腺激素释放激素（GnRH）（A对BCDE错）逐渐增多，并呈脉冲式分泌，通过垂体门脉循环进入腺垂体（垂体前叶），刺激垂体促性腺激素（FSH和LH）的合成和释放。